物质滥用中的耐受性是指
A. 机体产生的一种心理上的适应性改变
B. 反复使用精神活性物质导致的一组症状
C. 长期使用精神活性物质造成的生理改变
D. 明知有害仍持续使用精神活性物质
E. 物质使用者必须增加剂量方能达到原先的效果

正确答案：E。物质使用者必须增加剂量方能达到原先的效果

解析：耐受性是一种状态，指药物使用者必须增加使用剂量方能获得所需的效果，或使用原来的剂量则达不到使用者所追求的效果（E对）。明知有害仍持续使用精神活性物质指物质的依赖（D错）。